白术的分泌组织是
A. 树脂道
B. 油管
C. 油室
D. 油细胞
E. 乳汁管

正确答案：C。油室